AB<SB见于
A. 代谢性酸中毒
B. 呼吸性酸中毒
C. 代谢性碱中毒
D. 呼吸性碱中毒
E. 酸碱平衡正常

正确答案：D。呼吸性碱中毒

解析：标准碳酸氢盐(SB)是标准化HCO3-后测量的数值，所以只受代谢因素影响，实际碳酸氢盐(AB)是指在隔绝空气的条件下测得的实际HCO3-，因而受呼吸和代谢两方面的影响。当发生呼吸性碱中毒（D对）时，由于SB只受代谢因素影响所以不变，由于CO2排除过多导致HCO3-下降，AB降低，故AB<SB。